氟伐他汀主要经过的代谢酶是
A. CYP3A4
B. CYP2C19
C. CYP2D6
D. CYP1A2
E. CYP2C9

正确答案：E。CYP2C9

解析：本题考查他汀类药物的代谢酶。氟伐他汀主要经过的代谢酶是CYP2C9（E对）。